根据传染病防治法，甲类传染病是指
A. 鼠疫、狂犬病
B. 黑热病、炭疽
C. 鼠疫、炭疽
D. 鼠疫、霍乱
E. 炭疽、霍乱

正确答案：D。鼠疫、霍乱